抑制环加氧酶的药物是
A. 卡托普利
B. 米力农
C. 氯沙坦
D. 洛伐他汀
E. 阿司匹林

正确答案：E。阿司匹林

解析：本题考查抑制环氧酶的药物。阿司匹林（E对）主要通过抑制环氧酶，抑制前列腺素和血栓素的合成；卡托普利（A错）为血管紧张素转换酶抑制剂；米力农（B错）为磷酸二酯酶Ⅲ抑制剂；氯沙坦（C错）为血管紧张素Ⅱ受体阻断剂；洛伐他汀（D错）为羟甲基戊二酰辅酶A还原酶抑制剂类调血脂药。